一种细胞因子可抑制其他细胞因子的功能
A. 细胞因子的多效性
B. 细胞因子的重叠性
C. 细胞因子的拮抗性
D. 细胞因子的协同性
E. 细胞因子的特异性

正确答案：C。细胞因子的拮抗性

解析：一种细胞因子可抑制其他细胞因子的功能，表现拮抗性，如IL-4抑制IFN-Y诱导Th0细胞向Th1细胞分化，IFN-γ抑制IL-4诱导Th0向Th2的分化。掌握“细胞因子及受体”知识点。